男，32岁。2日来右下后牙痛，不能咬物。半年前发现右下后牙龈有小包，平时无明显不适。检查见右上6远中面龋坏深，左上1龋深，穿髓孔探无感觉，叩诊（±），右下8和右下7间根尖处牙龈有瘘管开口，压挤少许脓液处。右下8前倾阻生，龈红肿明显，探龈袋深部有脓液。X片见右上6远中根尖周X线透射区不规则，边界模糊。引起主诉症状的患牙诊断是急性智齿冠周炎，为确诊牙龈瘘管的病源牙，应作瘘管诊断丝x线片，该患者的治疗设计如下，除外
A. 根尖手术
B. 充填治疗
C. 根管治疗
D. 消炎止痛
E. 拔除患牙

正确答案：A。根尖手术

解析：本题考查慢性根尖周脓肿及智齿冠周炎的治疗。右上6可能为慢性根尖周脓肿，应根管治疗（C对）后充填治疗（B对），根尖手术为根管治疗或再治疗失败的补充（A错，为本题的正确答案）。右下8有智齿冠周炎，急性期应消炎止痛（D对），在炎症控制后拔除患牙（E对），防止感染再发。